发生重大医疗过失行为，医疗机构应当在规定的时限向当地卫生行政部门报告，重大医疗过失行为是指下列哪种情形
A. 造成患者中度残疾
B. 造成患者一般功能障碍
C. 造成患者组织损伤导致一般功能障碍
D. 咋鹏程患者轻度残疾
E. 造成患者死亡或者可能为二级以上医疗事故

正确答案：E。造成患者死亡或者可能为二级以上医疗事故

解析：有下列情形之一的，县级入民政卫生行政部门应当自接到医疗机构的报告或者当事人提出医疗事故等医疗损害争议处理申请之日起7日内移送上一级人民政府卫生行政部门处理：①患者死亡；②可能为二级以上的医疗事故；③国务院卫生行政部门和省、自治区、直辖市人民政府卫生行政部门规定的其他情形（E对）。